某男，51岁。素有高血压，症见头昏胀痛，两侧为重，耳鸣目眩，心烦易怒，夜寐不宁，口苦面红；舌红苔黄，脉弦数。患者近日因操劳过度，情志所伤，突发口眼㖞斜，舌强语謇，半身不遂；舌质红苔黄，脉弦。辨析其证候是
A. 痰热阻络
B. 风痰入络
C. 风阳上扰
D. 气虚血瘀
E. 气滞血瘀

正确答案：C。风阳上扰

解析：本题考查中风之风阳上扰的症状。中医辨证是中风之风阳上扰（C对）。中风之风阳上扰证【症状】平素头晕头痛，耳鸣目眩，突然发生口眼㖞斜，舌强语謇，或手足重滞，甚则半身不遂。舌质红苔黄，脉弦。胁痛之瘀血阻络（A错）证【症状】胁肋刺痛，痛有定处，痛处拒按，入夜痛甚，胁肋下或见有积块。舌质紫暗，脉沉涩。中风之风痰入络（B错）证【症状】肌肤不仁，手足麻木，突然发生口眼㖞斜，语言不利，口角流涎，舌强语謇，甚则半身不遂，或兼见手足拘挛，关节酸痛等症。舌苔薄白，脉浮数。中风之气虚血瘀（D错）证【症状】肢体偏枯不用，肢软无力，面色萎黄。舌质淡紫或有瘀斑，苔薄白，脉细涩或细弱。胸痹之气滞血瘀（E错）证【症状】心胸疼痛，如刺如绞，痛有定处，入夜为甚，重者心痛彻背，背痛彻心，或痛引肩背，伴有胸闷，日久不愈，可因暴怒、劳累而加重。舌质紫暗，有瘀斑，苔薄，脉弦细。